某男，67岁。症见口舌生疮、腰膝冷痛、大便溏薄。证属下元虚冷、虚阳上浮，宜选用的药是
A. 丁香
B. 荜茇
C. 干姜
D. 肉桂
E. 高良姜

正确答案：D。肉桂

解析：本题考查的是肉桂的主治病证。症见口舌生疮、腰膝冷痛、大便溏薄。证属下元虚冷、虚阳上浮，宜选用的药是肉桂（D对）。肉桂：【主治病证】（1）肾阳不足、命门火衰之阳痿、宫冷、畏寒肢冷。（2）下元虚冷、虚阳上浮之上热下寒证。（3）阳虚中寒之脘腹冷痛、食少便溏。（4）经寒血滞之痛经、闭经，寒疝腹痛，寒湿痹痛，腰痛。（5）阴疽，痈肿脓成不溃或久溃不敛。丁香（A错）：【主治病证】（1）中寒呃逆、呕吐、泄泻，脘腹冷痛。（2）肾阳虚之阳痿、宫冷。荜茇（B错）：【主治病证】（1）脘腹冷痛，中寒呕吐、泄泻。（2）胸痹冷痛，龋齿牙痛。干姜（C错）：【主治病证】（1）脾胃受寒或虚寒所致的腹痛、呕吐、泄泻。（2）亡阳欲脱。（3）寒饮咳喘。高良姜（E错）：【主治病证】中寒腹痛、呕吐、泄泻。